具有抗动脉粥样硬化作用的脂类是
A. 甘油三酯
B. 胆固醇
C. HDL
D. LDL
E. VLDL

正确答案：C。HDL

解析：甘油三酯（A错）、胆固醇（B错）、LDL（低密度脂蛋白）（D错）和VLDL（极低密度脂蛋白）（E错）均为动脉粥样硬化（AS）的致病因素，HDL（高密度脂蛋白）（C对）可通过胆固醇逆向转运机制清除动脉壁的胆固醇，防止AS的发生；还可防止LDL的氧化，竞争性抑制LDL与内皮细胞的受体结合而减少其摄取，防止AS的发生。